男，50岁。持续胸痛8小时。喘憋2小时入院。既往无高血压病史。查体：BP150/70mmHg，端坐位，双肺可闻及少许细湿啰音，心界不大，心率110次/分，律齐，P₂＞A₂。心电图示I、aVL、V₁～V₆导联ST段抬高0.1～0.4mv。可见病理性Q波。该患者最可能的诊断是
A. 高血压急症
B. 肥厚型心肌病
C. 急性心肌梗死
D. 急性心肌炎
E. 急性心包炎

正确答案：C。急性心肌梗死

解析：男，50岁。持续胸痛8小时（疼痛）。喘憋2小时入院。既往无高血压病史。查体：BP150/70mmHg，端坐位，双肺可闻及少许细湿啰音，心界不大，心率110次/分，率齐，P₂＞A₂。心电图示I、aVL、V₁～V₆导联ST段抬高0.1～0.4mv。可见病理性Q波（特征性心电图表现）。根据病史、临床表现、心电图，该患者最可能的诊断是急性心肌梗死（C对）。